翼下颌间隙脓肿口内切开引流应做的切开是
A. 下颌角下2cm绕下颌角弧形切口
B. 口内翼下颌皱襞内侧纵形切口
C. 下颌骨下缘上2cm作平行切口
D. 口内翼下颌皱襞稍外侧处纵行切开2～3cm
E. 下颌骨下缘下1～1.5cm作平行切口

正确答案：D。口内翼下颌皱襞稍外侧处纵行切开2～3cm

解析：翼下颌间隙口内切口在下颌支前缘稍内侧，即翼下颌皱襞稍外侧，纵行切开2～3cm，血管钳钝性分离开颊肌后，即可沿下颌支内侧进入翼下颌间隙。掌握“翼下颌间隙、颞下间隙感染”知识点。